某男，20岁，3月1日，与正在发热的母亲进餐，3月3日母亲被确诊为新冠肺炎患者，对男子采取的措施是
A. 自我健康检测
B. 给予口服预防药物
C. 隔离治疗
D. 隔离观察
E. 注射丙种球蛋白

正确答案：D。隔离观察

解析：将密切接触者、入境人员隔离管控时间为“7天集中隔离医学观察+3天居家健康监测”（D对）。